（133～134题共用题干）男，35岁。尿频、尿急、尿痛及右侧阴囊肿痛6个月。既往有肺结核病史。查体：右侧附睾尾部肿大、质硬。为了解是否同时存在泌尿系统病变，最有价值的检查是
A. 泌尿系统B超
B. MRI
C. 输尿管镜检查
D. 静脉尿路造影
E. 尿常规

正确答案：D。静脉尿路造影

解析：患者尿频、尿急、尿痛及右侧阴囊肿痛6个月，为了解是否同时存在泌尿系统病变，可行静脉尿路造影（D对）。尿道造影可显示前列腺部尿道变形或扩大，造影剂可进入前列腺空洞内（P549）。